以下关于眶下间隙的境界描述中，正确的是
A. 上界眶下缘
B. 下界口轮匝肌
C. 内界颧肌
D. 外界颊肌
E. 位于眼眶后部的上方

正确答案：A。上界眶下缘

解析：眶下间隙位于眼眶前部的下方。上界为眶下缘，下界为上颌骨牙槽突，内界为鼻侧缘，外以颧肌为界。掌握“面侧深区及颌面部各间隙的境界”知识点。